诱发破伤风全身肌肉痉挛不常见的因素是
A. 光线
B. 温度
C. 声音
D. 震动
E. 碰触

正确答案：B。温度

解析：破伤风的典型症状是在肌紧张性收缩的基础上，阵发性强烈痉挛，通常最先受影响的肌群是咀嚼肌，随后顺序为面部表情肌、颈、背、腹、四肢肌，最后为膈肌。全身肌肉痉挛可因轻微的刺激，如光线（A错）、声音（C错）、震动（D错）、碰触（E错）、饮水等而诱发。温度（B对）不是诱发破伤风全身痉挛的常见因素。